脊神经的说法中,何者错误
A. 每对脊神经都由前根、后根组成
B. 前根为运动性,后根为感觉性
C. 前、后两支均含有感觉纤维和运动纤维
D. 分布于皮肤的称皮支,分布于肌肉的称肌支
E. 前根与后根在出椎间孔后合成脊神经

正确答案：E。前根与后根在出椎间孔后合成脊神经

解析：前根后根在椎间孔处合成脊神经（E错，为本题正确选项）。